肝素的抗凝作用特点是
A. 作用缓慢
B. 体内、体外均有效
C. 仅在体外有效
D. 仅在体内有效
E. 必须有维生素K辅助

正确答案：B。体内、体外均有效

解析：本题考查肝素的作用特点。肝素通过激活一种抗凝血酶Ⅲ而发挥抗凝作用，起效迅速（A错），在体内外均有抗凝作用（B对CD错），不需要维生素K的辅助（E错）。